在医德评价中，自我评价方式及主观评价力量是指
A. 社会舆论
B. 传统习俗
C. 内心信念
D. 病人评议
E. 院内评价

正确答案：C。内心信念